背阔肌可使
A. 肩胛骨后移、旋外
B. 肩关节旋外、后伸
C. 肩关节内收、后伸
D. 肩关节内收、旋外
E. 脊柱向同侧屈

正确答案：C。肩关节内收、后伸

解析：背阔肌可使肩关节内收、后伸（C对）及旋内。